患儿，女，5岁，误服灭鼠药（氟乙酰胺），可选用的解救药物是
A. 亚甲蓝
B. 氟马西尼
C. 纳洛酮
D. 二巯丙醇
E. 乙酰胺

正确答案：E。乙酰胺

解析：本题考查氟乙酰胺的中毒解救。乙酰胺（解氟灵）（E对）是氟乙酰胺中毒的特殊解毒药，用于有机氟杀虫农药中毒。亚甲蓝（A错）用于氰化物中毒，小剂量可治疗高铁血红蛋白血症（亚硝酸盐中毒等）。氟马西尼（B错）可用于苯二氮䓬类药物过量或中毒解救。纳洛酮（C错）用于急性阿片类中毒（表现为中枢和呼吸抑制）及急性酒精中毒。二巯丙醇（D错）用于砷、汞、金、铋及酒石酸锑钾中毒。